小儿骨髓外的造血器官是
A. 胆囊
B. 肾上腺
C. 淋巴管
D. 肝脏
E. 盲肠

正确答案：D。肝脏

解析：肝脏（D对）、脾脏和淋巴结在贫血等机体造血需要增加的时候，可恢复造血状态，是小儿骨髓外的造血器官。